椎管内麻醉平面过高，可致
A. 血压下降
B. 呼吸抑制
C. 恶心呕吐
D. 头痛
E. 尿潴留

正确答案：A。血压下降

解析：血压下降的发生率与麻醉阻滞平面的高低成正比，所以椎管内麻醉平面过高，可致血压下降（A对）。硬膜外麻醉可能会出现血压下降、呼吸抑制、恶心呕吐（BC错）。椎管内麻醉由于某种原因引起脑脊液压力过低，可致头痛（D错）。尿潴留为椎管内麻醉常见并发症（E错）。